以下关于左旋多巴的叙述正确的是
A. 左旋多巴是多巴胺的前体
B. 左旋多巴口服后效果甚微
C. 左旋多巴要与L-芳香族氨基酸脱羧酶抑制药合用发挥作用
D. 左旋多巴是由酪氨酸形成儿茶酚胺的中间产物
E. 以上均对

正确答案：E。以上均对

解析：左旋多巴（L-DOPA）是由酪氨酸形成儿茶酚胺的中间产物，即DA的前体。口服后极大部分在外周组织被L-芳香族氨基酸脱羧酶脱羧成为多巴胺，仅1%左右的L-DOPA能进入中枢神经系统发挥疗效。若同时合用L-芳香族氨基酸脱羧酶抑制药，可减少外周DA生成，使左旋多巴更多地进入脑内，增加血和脑内L-DOPA达3～4倍，转化为DA而生效，并可减少不良反应。掌握“左旋多巴、卡比多巴、苯海索”知识点。